符合覆盖种植义生物力学原则的是
A. 种植体间距离22～27mm
B. 末端种植体应尽量植入位点靠前
C. 用曲杆连接种植体
D. 下颌颏孔区有5～6个种植体
E. 以上都对

正确答案：A。种植体间距离22～27mm

解析：可摘种植义齿主要见于全下颌覆盖种植义齿，通常在两侧颏孔区之间植入2～4个骨内种植体。其覆盖种植义齿的种植体植入位点间距以22～27mm为宜，其末端种植体应尽量植入位点靠后。且种植体不宜用曲杆连接，以免造成种植体骨界面之间的应力集中。掌握“种植义齿的组成和修复治疗原则”知识点。